患儿，女，3岁。生后发现口唇青紫，活动后加剧。平时喜蹲踞，哭吵时有突发呼吸急促、青紫加重，严重时伴晕厥，曾半年内晕厥2次，均于清晨或哭吵后发作，经2～3分钟自行恢复。今晨又出现晕厥，持续5分钟，即来急诊。查体：T37.0℃，P100次/分，R22次/分，BP82/55mmHg。神志不消，双肺听诊未见异常，胸骨左缘第2～4肋间闻及3/6级收缩期杂音，无震颤，肺动脉第二心音减弱。口唇青紫，指、趾甲青紫，杵状指、趾，颈软，神经系统查体无异常。患儿晕厥的原因是
A. 肺动脉漏斗部痉挛
B. 血流缓慢
C. 脑血栓形成
D. 长期缺氧
E. 血液黏稠

正确答案：A。肺动脉漏斗部痉挛

解析：女性患儿，有青紫、杵状指、趾、蹲踞及阵发性缺氧发作的表现。神志不清，双肺听诊未见异常，胸骨左缘第2～4肋间闻及3/6级收缩期杂音（肺动脉狭窄表现），无震颤，肺动脉第二心音减弱。综合患者的症状、体征和辅助检查，最可能的诊断为法洛四联症。患儿晕厥的原因是肺动脉漏斗部痉挛（A对），引起一时性肺动脉梗阻，使脑缺氧加重。血流缓慢（B错）、血液黏稠（E错）多引起脑血栓形成（C错），而不是晕厥。由于是一时性肺动脉梗阻，所以引起的是短期缺氧而不是长期缺氧（D错）。